女，30岁。持续高烧2周，于8月入院。查体：T39.8/℃，脉搏86次/分，神志清楚，表情淡漠，面色苍白，前胸部可见散在红色斑丘疹，脾肋下可及。为确诊最有意义的检查是
A. 出血热病毒抗体
B. 外斐反应
C. 肥达反应
D. 血涂片查疟原虫
E. 血细菌培养

正确答案：E。血细菌培养

解析：女性患者，持续高烧2周，体温39.8℃（持续高热），脉搏86次/分，神志清楚，表情淡漠，面色苍白（出现神经系统中毒症状），前胸部可见散在红色斑丘疹（胸部出现玫瑰疹），脾肋下可及（脾肿大），根据患者临床表现和病史，拟诊断为肠热症，首先考虑为伤寒。伤寒是由伤寒沙门菌引起的一种急性肠道传染病，本例患者发病2周，伤寒发病后2周内血培养的结果更可靠，为确诊最有意义的检查是血细菌培养（E对）。出血热病毒抗体（A错）用于辅助诊断出血热，这类疾病临床上以高热、出血、低血压（3“H”）为主要的共同特征，死亡率较高（P286）。外斐反应（B错）过去为流行性斑疹伤寒的诊断依据，利用变形杆菌的某些菌株的菌体抗原代替立克次体相应抗原以检测相应抗体的凝集反应，但特异性差（八版传染病学P136）。肥达反应（C错）是利用伤寒和副伤寒沙门菌菌液为抗原，检测病人血清中有无相应抗体的一种凝集试验，用于伤寒、副伤寒的辅助诊断，试验结果的解释必须结合临床表现、病程、病史及地区流行病学情况综合分析（P120）。血涂片查疟原虫（D错）对判断疟原虫密度有重要意义，用于确定诊断疟疾，疟疾是由疟原虫感染引起的寄生虫病，临床上以反复发作的间歇性寒战、高热、继之出大汗后缓解为特征（八版传染病学P284）。